他汀类药物的临床应用有
A. 动脉粥样硬化
B. 肾病综合征
C. 血管成形术后再狭窄
D. 预防心脑血管急性事件
E. 心律失常

正确答案：A、B、C、D。动脉粥样硬化；肾病综合征；血管成形术后再狭窄；预防心脑血管急性事件

解析：本题考查他汀类药物的临床应用。他汀类药物的临床应用：1.调血脂。2.肾病综合征（B对）。3.血管成形术后再狭窄（C对）。4.预防心脑血管急性事件（D对）：他汀类能通过增加动脉粥样硬化斑块的稳定性或使斑块 缩小而减少脑卒中或心肌梗死的发生（A对）。5.缓解器官移植后的排斥反应和治疗骨质疏松。